正确保管牙刷的方法为
A. 刷牙后要用清水多次冲洗牙刷
B. 牙刷置于通风处充分干燥
C. 刷毛上的水分甩干
D. 不可浸泡在沸水中
E. 以上均正确

正确答案：E。以上均正确

解析：牙刷的保管：刷牙后，牙刷毛间往往黏有口腔中的食物残渣，同时，也有许多细菌附着在上面。因此，要用清水多次冲洗牙刷，并将刷毛上的水分甩干，置于通风处充分干燥。牙刷应每人一把以防止交叉感染。尼龙牙刷不可浸泡在沸水中，更不能用煮沸法消毒，因为刷毛受高热易弯曲变形，牙刷用旧后刷毛卷曲不仅失去清洁作用且会擦伤牙龈，应及时更换。掌握“自我口腔保健方法”知识点。